关于梅毒血清试验叙述错误的是
A. 非梅毒螺旋体抗原血清试验用心磷脂做抗原，测定血清中抗心磷脂抗体（反应素）
B. 非梅毒螺旋体抗原血清试验特异性高而敏感性较低
C. 早期梅毒患者经充分治疗后，反应素可以消失
D. 梅毒螺旋体抗原血清试验敏感性和特异性均较高
E. 梅毒螺旋体抗原血清试验不能用于观察疗效

正确答案：B。非梅毒螺旋体抗原血清试验特异性高而敏感性较低

解析：梅毒血清试验分为非梅毒螺旋体抗原血清试验和梅毒螺旋体抗原血清试验。非梅毒螺旋体抗原血清试验用（牛心肌）心磷脂做抗原，测定血清中抗心憐脂抗体（反应素）（A对）。非梅毒螺旋体抗原血清试验均采用非特异性抗原，因此特异性不高，一些非梅毒疾病如红斑狼疮、类风湿新关节炎、疟疾、麻风等病人血清也可呈现假阳性结果；该实验敏感性高，可用作临床筛选，并可作定量，用于疗效观察（B错，为本题正确答案）。梅毒螺旋体血清试验采用特异性抗原检测病人血清中的特异性抗体，试验敏感性和特异性均较高，主要用于诊断试验，不用于观察疗效（DE对）。梅毒确诊后，应及早应予以彻底治疗，早期梅毒患者经充分治疗后，反应素可以消失，以血清反应素抗体转阴为治愈指标，且治疗结束后需定期复查（C对）。